人肠道细菌的种类可达
A. 200～800种
B. 300～1000种
C. 400～1100种
D. 500～1200种
E. 600～1800种

正确答案：B。300～1000种

解析：肠道菌群是定居在人消化道中菌群的集合。人肠道细菌的种类可达300～1000种。肠道细菌促进肠道黏膜免疫系统的早期发育，促进肠黏膜相关的淋巴组织中的B细胞产生针对病原体的抗体。掌握“黏膜免疫”知识点。